足月妊娠阴道出血的孕妇，为明确前置胎盘诊断，入院后应即行
A. 肛门检查
B. 放射性核素扫描
C. X线软组织摄影
D. 超声波定位
E. 输液备血阴道检查

正确答案：D。超声波定位

解析：B超检查可清楚显示子宫壁、胎盘、胎先露部及宫颈的位置，并根据胎盘下缘与宫颈内口的关系，确定前置胎盘的类型。为前置胎盘的首选检查。掌握“前置胎盘”知识点。